糖尿病人由于反复注射胰岛素，在注射局部出现红肿，出血，坏死等剧烈的炎症，应是
A. 类风湿关节炎
B. 类Arthus反应
C. 血清病
D. 免疫复合物型肾小球性肾炎
E. SLE

正确答案：B。类Arthus反应